在特定穴中，络穴主要用于治疗
A. 五脏病证
B. 六腑病证
C. 五脏六腑病证
D. 急性病证
E. 表里经脉病证

正确答案：E。表里经脉病证

解析：络穴是络脉从本经别出的部位。络穴的临床应用，除可治疗其络脉的病证外，由于十二经之络脉具有加强表里两经联系的作用，络穴又可治疗表里两经的病证（E对）。脏病第十版针灸学（阴病）多与背俞穴第十版针灸学（阳部）相关，腑病第十版针灸学（阳病）多与募穴第十版针灸学（阴部）联系，临床上腑病多选其募穴，脏病多选其背俞穴（A错）；下合穴主要用于治疗六腑疾病（B错）；原穴主要用于治疗五脏六腑病证（C错）；郄穴是治疗本经和相应脏腑病证的重要穴位，尤其在治疗急症方面有独特的疗效（D错）。